乙酰水杨酸小剂量服用可防止脑血栓形成，是因为它有哪项作用
A. 使PG合成酶失活并减少TXA₂的生成
B. 稳定溶酶体膜
C. 解热作用
D. 抗炎作用
E. 水杨酸反应

正确答案：A。使PG合成酶失活并减少TXA₂的生成

解析：本题考查乙酰水杨酸的作用。乙酰水杨酸小剂量服用可防止脑血栓形成，是因为它有使PG合成酶失活并减少TXA₂的生成（A对）的作用。